几种实验动物的一次灌胃容量范围正确的是
A. 小鼠0.1～0.5ml/100g
B. 大鼠1ml/10g
C. 家兔﹤5ml/kg
D. 狗﹤50ml/kg
E. 以上均正确

正确答案：C。家兔﹤5ml/kg